在流行病学研究中，用对照组的发病率除以接种组的发病率称为
A. 相对危险度
B. 特异危险度
C. 保护率
D. 效果指数
E. 抗体阳转率

正确答案：D。效果指数